最常见的继发性闭经类型是
A. 子宫性闭经
B. 卵巢性闭经
C. 垂体性闭经
D. 下丘脑性闭经
E. 原发性闭经

正确答案：D。下丘脑性闭经

解析：闭经为常见的妇科症状，表现为无月经或月经停止。根据既往有无月经来潮，分为原发性闭经和继发性闭经两类。继发性闭经发病率明显高于原发性闭经（E错）。以下丘脑性（D对）最常见，依次为垂体（C错）、卵巢（B错）、子宫性（A错）及下生殖道发育异常闭经。